室内空气氡主要来自
A. 房屋地基及建筑材料
B. 吸烟
C. 人的呼出气
D. 燃料的燃烧
E. 家用电器

正确答案：A。房屋地基及建筑材料

解析：本题考查室内空气氡主要来源。室内空气氡主要来自房屋地基及建筑材料（A对BCDE错）。